为比较工人、干部中高血压患病率的差别，最适合的流行病学研究方法为
A. 生态学研究
B. 现况调查
C. 病例对照研究
D. 队列研究
E. 社区实验

正确答案：B。现况调查